蓬莪术的根茎常伪充
A. 天麻
B. 山药
C. 西洋参
D. 三 七
E. 天花粉

正确答案：D。三 七